许多呼吸道传染病存在周期性流行的现象、其主要原因是
A. 易感者的积累
B. 自然环境的周期性变化
C. 人口流动
D. 发病率变动
E. 以上都不是

正确答案：A。易感者的积累

解析：本题考查疾病周期性流行的原因。疾病周期性的变化多见于呼吸道传染病，其主要是由于易感者积累（A对BCDE错）使人群易感性增加，形成发病率增高的现象。